患者，男，70岁急性心肌梗死，突发昏厥，心电图电活动无可辨认的QRS波群ST段及T波，频率为400～450次/分其诊断是
A. 心房纤颤
B. 窦性停搏
C. 室性心动过速
D. 心室扑动
E. 心室颤动

正确答案：E。心室颤动

解析：心室颤动心电图特点是：①P-QRS-T波群完全消失，代之以形状不一、大小不等、极不规则的室颤波。②室颤波的频率为250～500次/min。最初的颤动波常较粗大，以后逐渐变小，如抢救无效，最终将变为等电位线，示心脏电活动停止（E对）。心房颤动心电图特点是：①f波：P波消失，代以大小不等、形态不同、间距不匀齐的房颤波（f波），f波频率为350～600次/min。通常在V₁导联最清楚，其次为Ⅱ、Ⅲ、aVF导联。②RR间期绝对不齐，即心室律绝对不规则。③QRS波群形态正常，有时可因室内差异传导或伴室内传导阻滞而增宽（A错）。窦性停搏的心电图特点是：①在PP间期规则的心电图记录中，出现1个或多个显著延长的PP间期，延长的PP间期之中没有窦性P波及相关的QRS波群；而长PP间期与短的PP间期之间无倍数关系。②较长时间的窦性停搏后可出现窦性心搏，也常出现交界性逸博或室性逸搏（B错）。室性心动过速的心电图特点是：①连续3次或3次以上室性期前收缩，频率多在100～250次/min，节律大致规则，可略有不齐。②QRS波群宽大畸形，时间≥0.12s，T波与QRS波群主波方向相反。③房室分离。④心室夺获与室性融合波（C错）。心室扑动的心电图特点是：①QRS-T波群消失，代之以连续、快速而相对规则的大振幅的室扑波。②室扑波的频率为150～250次/min（D错）。